热原系指能引起恒温动物体温异常升高的致热物质，其中致热活性特别强的是
A. 脂肪酸
B. 脂多糖
C. 磷脂
D. 蛋白质
E. 胆固醇

正确答案：B。脂多糖